属于麻醉药品的是
A. 阿片类
B. 镇静催眠药
C. 烟草
D. 水杨酸类
E. 酒精

正确答案：A。阿片类

解析：麻醉药品是指对中枢神经系统有麻醉作用，连续使用、滥用或者不合理使用以产生依赖性和精神依赖性，能成瘾癖的药品。麻醉药品包括阿片类（A对）、可卡因类、大麻类、合成类麻醉药品等。